功能燥湿健脾，祛风湿，发汗，明目的药物是
A. 苍术
B. 厚朴
C. 藿香
D. 佩兰
E. 砂仁

正确答案：A。苍术

解析：苍术的功效是燥湿健脾，祛风散寒，明目（A对）。厚朴（B错）的功效是燥湿消痰，下气除满。藿香（C错）的功效是芳香化湿，和中止呕，发表解暑。佩兰（D错）的功效是芳香化湿，醒脾开胃，发表解暑。砂仁（E错）的功效是化湿开胃，温脾止泻，理气安胎。